患者，男，45岁，检查结果：血尿酸580μ㏖/L，尿尿酸＜600mg/24h（尿酸排泄减少）。宜选用的降尿酸药物是
A. 苯溴马隆
B. 吲哚美辛
C. 氢氯噻嗪
D. 非布司他
E. 秋水仙碱

正确答案：A。苯溴马隆

解析：本题考查抗痛风药物。苯溴马隆（A对）是促进尿酸排泄药物，通过抑制肾小管尿酸转运蛋白-1（URAT-1），阻抑肾小管尿酸重吸收而促进尿酸排泄，降低血尿酸水平。